内服能清肝明目的药是
A. 滑石
B. 血竭
C. 硼砂
D. 车前子
E. 地肤子

正确答案：D。车前子

解析：本题考查的是车前子的性能特点。内服能清肝明目的药是车前子（D对）。车前子：【性能特点】本品甘寒质滑清利，入肾经，既利水清热而通淋，又实大便而止泻，治下焦湿热、水肿有热及暑湿水泻；入肝经，清泻肝火而明目，治肝热目赤；入肺经，清肺化痰而止咳，治痰热咳嗽。故凡湿热、肝热、痰热所致病证均可选用。滑石（A错）：【性能特点】本品甘淡寒清滑利，入膀胱、肺、胃经。内服清利，既清膀胱湿热而利尿通淋，为治湿热淋痛之良药；又清解暑热，为治暑湿、湿温之佳品。外用清敛，能清热、收湿敛疮，治湿疮、湿疹常用。血竭（B错）：【性能特点】本品咸走血软坚，甘平性缓，行中有止，入心、肝经。既能活血散瘀而止痛，治血瘀诸证；又能化瘀收敛而止血，治外伤出血；还能生肌消肿而敛疮，治疮疡不敛。硼砂（C错）：【性能特点】本品甘能解毒，咸能软坚，凉可清热，入肺、胃经。外用清热解毒、消肿防腐，治喉肿、口疮、目疾。内服清肺热、化稠痰，治肺热痰黄、咳吐不利。地肤子（E错）：【性能特点】本品甘寒清利，苦泄辛散，入肾与膀胱经。既利尿通淋，又祛风止痒，为治热淋及疮疹湿痒之要药。